依照《执业医师法》的规定，不予注册的情形没有包括
A. 不具有完全民事行为能力
B. 受刑事处罚不满两年的
C. 受吊销医师执业证书行政处罚不满两年的
D. 变更执业地点和范围的
E. 国家卫生行政部门规定的其他不予注册的情形

正确答案：D。变更执业地点和范围的